影响药物制剂稳定性的处方因素有
A. pH值
B. 抗氧剂
C. 温度
D. 金属离子络合剂
E. 光线

正确答案：A、B、D。pH值；抗氧剂；金属离子络合剂

解析：本题考查影响药物制剂稳定性的因素。pH值（A对）、抗氧剂（B对）、金属离子络合剂（D对）属于影响药物制剂稳定性的处方因素。影响药物制剂稳定性的因素包括处方因素和外界因素。其中，处方因素包括pH值、广义酸碱催化反应、溶剂、离子强度、表面活性剂、处方中基质以及赋形剂。抗氧剂属于处方因素中离子强度的影响，通过往制剂处方中加入一些有抗氧化作用的无机盐，可以防止药物的氧化。金属离子络合剂属于注射剂中常用的附加剂，防止制剂过程中所用的原辅料及器具中金属离子的影响。外界因素包括温度（C错）、光线（E错）、空气（氧）、金属离子、湿度和水分、包装材料。温度的影响：一般来说，温度升高，反应速度加快，不同反应增加的倍数可能不同，它是药物稳定性预测的主要理论依据。光线的影响：光是一种辐射能，光线的波长越短，能量越大，光线提供的能量可激发氧化反应，加速药物的降解。